关于躯体感觉中枢的位置
A. 颞横回
B. 额下回
C. 中央前回
D. 中央后回和旁中央小叶后部
E. 角回

正确答案：D。中央后回和旁中央小叶后部

解析：躯体感觉中枢位于中央后回和中央旁小叶后部（D对），接受背侧丘脑腹后核传来的对侧半身痛、温、触、压以及位置和运动觉。颞横回（A错）为听觉中枢，接受内侧膝状体来的纤维，每侧听觉中枢均接受来自两耳的冲动。额下回（B错）为运动语言中枢，该中枢主司说话功能，损伤后出现病人能发音却不能说出具有意义的语言，称运动性失语症。中央前回（C错）和旁中央小叶前部为第Ⅰ躯体运动区所在位置，与管理全身骨骼肌运动相关，损伤后可出现上运动神经元性瘫痪。角回（E错）为视觉语言中枢，该中枢与文字的理解和认图密切相关，损伤后可出现视觉无障碍但对原来认识的字不能阅读，也不理解文字符号的意义，称失读症。